具有涩肠，止血，杀虫功效的药物是
A. 椿皮
B. 苦楝皮
C. 贯众
D. 榧子
E. 肉豆蔻

正确答案：A。椿皮

解析：该题考查椿皮的功效，属记忆内容。椿皮味苦、涩，性寒；入大肠、肝经；具有清热燥湿，收敛止带，止泻，止血的功效，本品还尚有杀虫功效，内服治蛔虫腹痛，外洗治疥癣瘙痒（A对）。苦楝皮具有杀虫作用而没有涩肠，止血的功效（B错）。贯众为清热解毒药，具有清热解毒，凉血止血，杀虫的功效，贯众味苦，性微寒，有小毒；入肝、脾经，没有涩肠的功效（C错）。榧子为杀虫药，具有杀虫的功效而没有涩肠、止血的功效（D错）。肉豆蔻为涩肠药，具有涩肠的功效，没有止血，杀虫的功效（E错）。